抗生素属于
A. 消毒剂
B. 灭菌剂
C. 抑菌剂
D. 防腐剂
E. 缓冲剂

正确答案：C。抑菌剂

解析：本题考查抗生素。抗生素属于抑菌剂（C对）。抗生素是由各种微生物（包括细菌、真菌、放线菌属）产生的，能杀灭或抑制其他微生物的物质。抗生素分为天然抗生素和人工半合成抗生素，前者由微生物产生，后者是对天然抗生素进行结构改造获得的半合成产品。